重度先兆子痫孕妇血液生化改变不包括
A. 尿酸增高
B. 尿素氮增高
C. 血浆蛋白降低
D. 二氧化碳结合力升高
E. 血小板计数降低

正确答案：D。二氧化碳结合力升高

解析：重度先兆子痫即重度子痫前期，属于妊娠期高血压疾病的一种严重类型，其基本病理生理变化是全身小血管痉挛，内皮损伤及局部缺血，引起各脏器灌流减少，导致功能障碍。肾功能障碍时，肾小球滤过量下降，出现尿酸（A对）和尿素氮（B对）增高（P65）。肝功能障碍时，合成血浆蛋白的能力下降，血浆蛋白降低（C对）。重度先兆子痫患者常伴有血液高凝状态，发生微血管病性溶血，可表现为血小板计数的降低（E对）。子痫抽搐后，乳酸性酸中毒及呼吸代偿性排出的二氧化碳丢失，可致血中碳酸氢盐浓度降低，相应的二氧化碳结合力降低（D错，为本题正确答案）。